确定传染病患者隔离期限的依据是
A. 潜伏期
B. 临床症状期
C. 恢复期
D. 传染期
E. 治疗期

正确答案：D。传染期